男，59岁，进行性记忆力下降6个月。怀疑有人偷自己的东西，认为爱人对自己不忠诚，常与邻居发生争执，有时尾随年轻女性，行为幼稚、任性。家人无法管理而住院治疗。既往无脑血管病史。生命征及神经系统检查正常。【假设信息】该患者在住院期间，突然出现大量丰富的幻觉，这时对症处理应选用的药物是
A. 丙戊酸钠
B. 利培酮
C. 丁螺环酮
D. 阿普唑仑
E. 曲唑酮

正确答案：B。利培酮

解析：患者诊断为阿尔茨海默病，在住院期突然出现大量丰富的幻觉（精神症状），此时应选用的药物为抗精神病药物，常用的抗精神病药物包括：氯丙嗪、利培酮（B对）、氯氮平、奥氮平、喹硫平等。丙戊酸钠（A错）（P242）是抗癫痫药，可用于躁狂症的治疗。丁螺环酮（C错）（P244）是非苯二氮䓬类抗焦虑药物，主要适用于各种神经症所致的焦虑状态以及躯体疾病伴发的焦虑状态，还可用于抑郁症的增效治疗。阿普唑仑（D错）（P243）是苯二氮䓬类镇静催眠药，具有抗焦虑、镇静催眠、抗惊厥作用。曲唑酮（E错）属于抗抑郁药，用于治疗抑郁症，具有镇静作用，适于夜间给药。